部分头孢菌结构中含有甲硫四氮唑侧链，可以竞争性结合γ谷氨酸羟化酶，抑制肠道正常菌群，由此导致的不良反应是
A. 凝血功能障碍
B. 排异功能障碍
C. 造血功能障碍
D. 免疫功能障碍
E. 勃起功能障碍

正确答案：A。凝血功能障碍

解析：本题考查头孢类药物。头孢孟多酯、头孢唑啉等含有甲硫四氮唑侧链，与维生素K竞争性结合谷氨酸-γ羟化酶，抑制肠道正常菌群，减少维生素K的合成，导致维生素K依赖性凝血因子合成障碍，从而凝血过程发生障碍（A对）。